至虚有盛候属于
A. 虚实转化
B. 虚实错杂
C. 真虚假实
D. 真实假虚
E. 上虚下实

正确答案：C。真虚假实

解析：真虚假实证是指疾病的本质为虚证，反出现某些“盛实”的现象，即所谓“至虚有盛候”（C对）。虚实转化是指在疾病的发展过程中，由于正邪力量对比的变化，致使虚证与实证相互转化，形成相反的证（A错）。虚实错杂是指在同一患者身上，既有虚证，又有实证的情况（B错）。真实假虚证是指疾病的本质为实证，却出现某些“虚羸”的现象，即所谓“大实有羸状”（D错）。上虚下实表现为气血不足，例如头晕，上肢无力，面色不华等；下实表现为实证例如同时出现身体下部的感染，下焦湿热，小便发黄，大便干等症状（E错）。